患者，女，67岁，有高血压病史，右手抖动，行走缓慢4年，诊断为帕金森病。服用复方左旋多巴治疗，症状一度好转后又反复加重，随后采用加大复方左旋多巴剂量，并加用苯海索。患者同时服用氨氯地平、缬沙坦等药物控制血压。近日出现运动症状波动，伴有异动症。导致该不良反应的药物是
A. 左旋多巴
B. 苄丝肼
C. 苯海索
D. 氨氯地平
E. 缬沙坦

正确答案：A。左旋多巴

解析：本题考查药物的不良反应。左旋多巴（A对）可用于治疗帕金森病，易诱发致残性的运动并发症。苄丝肼（B错）多与左旋多巴合用，单用时不良反应很少。苯海索（C错）常见口干、视物模糊等，偶见心动过速、恶心、呕吐、尿潴留、便秘等。 氨氯地平（D错）的不良反应有心功能不全、低血压、面部潮红、下肢及踝部水肿等。缬沙坦（E错）常见不良反应为头疼和水肿。